临床用于各型肺结核和肺外结核。与异烟肼和利福平合用治疗初治患者，与利福平和卷曲霉素合用治疗复治患者的药物是
A. 乙胺丁醇
B. 氨苄西林
C. 奥美拉唑
D. 西咪替丁
E. 氟康唑

正确答案：A。乙胺丁醇

解析：乙胺丁醇临床用于各型肺结核和肺外结核。与异烟肼和利福平合用治疗初治患者，与利福平和卷曲霉素合用治疗复治患者。掌握“异烟肼、利福平及乙胺丁醇”知识点。